化学农药在土壤中的迁移转化，不正确的是
A. 土壤对农药的吸附表现为（有限的）净化作用
B. 化学农药能在土壤中挥发、扩散和迁移
C. 农药在土壤中的降解主要有光化学降解、化学降解和生物降解
D. 光化学降解是农药转化和消失的一个主要途径
E. 化学降解不仅受土壤的温度、水分和pH的影响，还与微生物有关

正确答案：E。化学降解不仅受土壤的温度、水分和pH的影响，还与微生物有关

解析：本题考查化学农药在土壤中的迁移转化。化学农药在土壤中的迁移转化包括：1.土壤对农药的吸附：土壤是一个由无机胶体（黏土矿物）、有机胶体（腐殖酸类）以及有机-无机胶体所组成的胶体体系，具有较强的吸附性能。所以，在某种意义上土壤对农药的吸附表现为（有限的）净化作用（A对）；2.化学农药在土壤中的挥发、扩散和迁移（B对）；3.农药在土壤中的降解过程：主要有光化学降解、化学降解和生物降解等作用（C对）。光化学降解指土壤表面接受太阳辐射和紫外线能量而引起农药的分解作用，这是农药转化和消失的一个主要途径（D对）；化学降解主要是水解和氧化作用，这种降解与微生物无关，但受土壤的温度、水分和pH的影响（E错，为本题正确答案）；生物降解主要是土壤中的微生物（包括细菌、霉菌、放线菌等）对有机农药的降解起着重要的作用。